反映直接作用于感觉器官的客观事物的个别属性的心理过程是
A. 感觉
B. 知觉
C. 记忆
D. 思维
E. 想象

正确答案：A。感觉